女性，26岁左乳房发现肿块1年，无疼痛查体：左乳外下象限可扪及2.5cm×1.5cm肿块，形如鸡卵，表面光滑，活动度好，应首先考虑的是
A. 乳腺增生病
B. 乳腺纤维瘤
C. 乳房结核
D. 乳腺癌
E. 乳腺导管内乳头状瘤

正确答案：B。乳腺纤维瘤

解析：患者乳房发现肿块1年，无疼痛，肿块形如鸡卵，表面光滑，活动度好，应首先考虑的是乳腺纤维瘤。卵巢功能旺盛，雌激素水平过高，调节失衡，加之患者对雌激素反应敏感，在雌激素的长期刺激下，引起乳腺腺上皮组织和纤维组织过度增生，结构紊乱，故形成肿瘤（B对）。乳腺增生病是指乳腺导管、乳腺小叶、腺泡上皮、纤维组织的单项或多项良性增生。以周期性加重的乳房胀痛和多发性乳房肿块为主要临床特点（A错）。凡中、青年女性出现乳房肿块，反复感染或脓肿形成，有自行溃破或经久不愈的窦道，或伴有全身性毒血症表现，如低热、体重下降、乏力等，均应考虑有乳房结核的可能（C错）。乳腺导管内乳头状瘤临床表现就是乳头溢液，乳头溢液主要是表现为单侧乳房单个乳管有血性和浆液性的乳头溢液（E错）。